腹部闭合性损伤X线检查发现右膈肌抬高，活动受限，最可能的损伤是
A. 胃破裂
B. 脾破裂
C. 肝破裂
D. 十二指肠破裂
E. 结肠肝曲破裂

正确答案：C。肝破裂

解析：X线检查发现右侧膈肌抬高，提示右侧膈下血肿或积液，在腹部闭合性损伤中，最可能的损伤是肝破裂（C对）。胃（A错）、十二指肠（D错）和结肠破裂（E错）X线表现为膈下新月形阴影；脾破裂（B错）X线表现为胃大弯下锯齿形压迹。X线： 肝破裂：积血，发现右侧膈肌抬高。 胃十二指肠、结肠破裂：膈下新月形阴影。 脾破裂：胃大弯下锯齿形压迹。 胰腺损伤合并损伤的器官：十二指肠损伤。